肝硬化患者使用后，易致肝性脑病的药物是
A. 地西泮
B. 普萘洛尔
C. 利福平
D. 磷苯乙肼
E. 维拉帕米

正确答案：B。普萘洛尔